以上药物中属于短效口服避孕药的是
A. 复发甲地孕酮片
B. 复方左旋18甲长效避孕片
C. 53号抗孕片
D. 更炔诺酮注射液
E. 甲硅环

正确答案：A。复发甲地孕酮片

解析：复方甲地孕酮片属于短小口服避孕药。掌握“激素避孕”知识点。